急性脑综合征最多见的幻觉是
A. 视幻觉
B. 听幻觉
C. 味幻觉
D. 触幻觉
E. 嗅幻觉

正确答案：A。视幻觉

解析：谵妄又称为急性脑综合征，主要特征为意识障碍，临床表现为急性、一过性、广泛性的认知障碍，其中感知障碍尤其常见，包括感觉过敏、错觉和幻觉，以视错觉和视幻觉（A对）最多见。听幻觉、味幻觉、触幻觉和嗅幻觉都不是急性脑综合征的常见幻觉（BCDE错）。